能够在镜下观察到牙髓表面鳞状上皮成分的牙髓炎为以下哪种
A. 慢性闭锁性牙髓炎
B. 慢性溃疡性牙髓炎
C. 息肉表面有复层鳞状上皮覆盖
D. 急性牙髓炎
E. 牙髓网状变性

正确答案：C。息肉表面有复层鳞状上皮覆盖

解析：慢性增生性牙髓炎又称牙髓息肉。牙髓息肉，分为溃疡型和上皮型，而上皮型在镜下见增生的炎症性息肉表面有复层鳞状上皮覆盖（C对）。